医师应当按照药品说明书中的下列要求开具处方，但不包括
A. 操作规程
B. 药品适应证
C. 药理作用
D. 不良反应
E. 注意事项

正确答案：A。操作规程

解析：医师应当根据医疗、预防、保健需要，按照诊疗规范、药品说明书中的药品适应证、药理作用、用法、用量、禁忌、不良反应和注意事项等开具处方。掌握“处方的开具、监督管理及法律责任”知识点。